婴儿(1岁)服用的中药煎出量是
A. 10~20ml
B. 21~30ml
C. 31~40ml
D. 41~50ml
E. 60~100ml

正确答案：E。60~100ml

解析：小儿用药剂量常随年龄大小、个体差异、病情轻重、方剂组合、药味多少等而不同，一般新生儿用量为成人的1/6，乳婴儿用量为成人的1/3，幼儿用量为成人的1/2。年龄越小药汁量越少，可采取少量多次喂服的方法，不必限制于1日2次。中药煎出量一般按一日算，成人为150~200ml左右，故煎出量约为60~100ml（E对）。